下颌骨侧位片主要用于观察
A. 下颌前牙区病变
B. 上颌窦部病变
C. 颞下颌关节间隙改变
D. 下颌骨体、升支及髁状突病变
E. 上颌骨骨折

正确答案：D。下颌骨体、升支及髁状突病变

解析：本题主要考查口外片。下颌骨侧位片主要用于观察下颌骨体、升支及髁状突病变（D对）。下颌骨侧斜位片：又称为下颌骨侧位片。为临床最常用的检查方法之一，用于检查下颌骨体部、升支及髁突的病变。由于下颌骨解剖形态呈弓形，在此位置上髁突易与关节窝、颈椎重叠，尖牙区易与对侧下颌骨体部重叠。如需观察髁突时，X线中心线通过下颌升支中部，此时称为下颌骨升支侧斜位。如需观察尖牙区时，则可使尖牙区紧贴暗盒，X线中心线通过尖牙区，此时称为下颌骨尖牙位。